肝性脑病注射支链氨基酸的主要作用是
A. 减少肠道内氨的形成和吸收
B. 纠正氨基酸不平衡
C. 降低门静脉压力
D. 纠正电解质紊乱
E. 纠正酸碱平衡紊乱

正确答案：B。纠正氨基酸不平衡

解析：支链氨基酸是一种以亮氨酸、异亮氨酸、缬氨酸等为主的复合氨基酸，其治疗肝性脑病的机制为竞争性抑制芳香族氨基酸进入大脑，纠正氨基酸不平衡（B对），减少假性神经递质的形成。减少肠道内氨的形成和吸收（A错）常用的药物是乳果糖。降低门静脉压力（C错）常用的是TIPs（肝颈静脉分流术）。